我国不少湖泊海湾水域不断发生水体富营养化现象，给当地居民造成巨大的经济损失，仅太湖流域每年因水体富营养化而造成的经济损失就约为50亿元左右。造成水体富营养化的主要污染物是
A. 有机氯和有机磷
B. 汞和镉
C. 磷和氮
D. 硫和碘
E. 铅和铝

正确答案：C。磷和氮

解析：本题考查造成水体富营养化的主要污染物。水体富营养化是指受含磷、氮（C对ABDE错）等污水污染造成水体中藻类大量繁殖，使水中有机物增加、溶解氧下降，水质恶化的现象。